以下是一所小学校教室的装修设计，哪项不符合学校卫生要求
A. 天棚和侧墙刷成白色
B. 前墙刷成米黄色
C. 课桌表面漆成暗蓝色
D. 窗外不能去除的遮挡物刷成白色
E. 黑板的宽度为1.2m，长度为4.0m

正确答案：C。课桌表面漆成暗蓝色